脑桥内与小脑有关
A. 三叉神经脑桥核
B. 上橄榄核
C. 脑桥核
D. 上泌涎核
E. 蜗神经核

正确答案：C。脑桥核

解析：脑桥核位于脑桥，接受来自同侧大脑皮质广泛区域的皮质脑桥纤维，发出脑桥小脑纤维横行越过中线至对侧，组成小脑中脚进入小脑，因而脑桥核（C对）与小脑有关。三叉神经脑桥核（A错）位于脑桥，主要接受头面部、口鼻腔的触压觉冲动。上橄榄核（B错）位于脑桥，与蜗腹侧前核共同根据双耳传导声音信息的时间和强度差参与声音的空间定位。上泌涎核（D错）位于脑桥，控制泪腺、舌下腺、下颌下腺的分泌。蜗神经核（E错）位于延髓，接受内耳螺旋器的听觉冲动。